用流行病学方法研究突发公共卫生事件的意义和重要性，下列说法正确的是
A. 利用流行病学的疾病监测技术，建立突发事件监测网，对突发事件实施连续监测，有助于获得我国各类突发事件的基线资料，以了解突发事件的流行状况和把握突发事件的流行形势
B. 运用流行病学的调查分析方法及分析的思维逻辑，对突发事件进行调查研究，有助于从宏观的角度来掌握突发事件在我国的流行特征，分析突发事件的分布和影响因素；有助于尽快查明突发事件的发生原因、发展规律，评估突发事件造成的危害及带来的需求
C. 采用流行病学方法，不但能动态观察各个地区突发公共卫生事件的发生频率和处理情况，还能够评价各个地区突发公共卫生事件的防制水平，进而调整全国突发公共卫生事件的工作重点
D. 以流行病学的策略和措施指导突发事件的预防和应急准备，有助于各地区根据自身特点和实际情况，选择合适的预防策略、应对预案和援救措施，从而提高我国突发事件的预防和处理能力
E. 以上都是

正确答案：E。以上都是

解析：本题考查流行病学方法研究公共卫生事件的意义和重要性。1.以流行病学的策略和措施指导突发事件的预防和应急准备，有助于各地区根据自身特点和实际情况，选择合适的预防策略、应对预案和援救措施，从而提高我国突发事件的预防和处理能力。2.运用流行病学的调查分析方法及分析的思维逻辑，对突发事件进行调查研究，有助于从宏观的角度来掌握突发事件在我国的流行特征，分析突发事件的分布和影响因素；有助于尽快查明突发事件的发生原因、发展规律，评估突发事件造成的危害及带来的需求。3.利用流行病学的疾病监测技术，建立突发事件监测网，对突发事件实施连续监测，有助于获得我国各类突发事件的基线资料，以了解突发事件的流行状况和把握突发事件的流行形势。4.采用流行病学方法，不但能动态观察各个地区突发公共卫生事件的发生频率和处理情况，还能够评价各个地区突发公共卫生事件的防制水平，进而调整全国突发公共卫生事件的工作重点（E对ABCD错）。